关于脊柱的描述，错误的是
A. 脊柱的运动属于联合运动
B. 脊柱有屈、伸、侧屈、旋转和环转运动
C. 脊柱有4个生理性弯曲
D. 颈曲和胸曲凸向前
E. 所有椎间盘的总厚度约占脊柱全长的1/4

正确答案：D。颈曲和胸曲凸向前

解析：脊柱有颈、胸、腰、骶4个生理弯曲（C对），其中其中，颈曲和腰曲凸向前（D错，为本题正确答案），胸曲和骶曲凸向后。可作屈、伸、侧屈、旋转和环转运动（B对），脊柱的所有运动是多个活动节段联合运动的结果，属于联合运动（A对），成人有23个椎间盘，占脊柱全长的1/4（E对）。